头发成斑片状脱落的原因是
A. 肾精亏损
B. 气血两虚
C. 久病体弱
D. 血虚受风
E. 血热

正确答案：D。血虚受风

解析：“斑秃是指片状脱发，显露圆形或椭圆形光亮头皮，多为血虚受风所致”（D对）。肾精亏损可见小儿头发稀疏黄软，生长迟缓，甚至久不生发者（A错）。气血两虚可见发黄或发白(B错)。久病体弱可见发黄（C错）。血热可见青壮年头发稀疏易落，伴有头皮发痒、多屑、多脂（E错）。